大脑皮质视觉区位于
A. 外侧沟两侧
B. 距状沟两侧
C. 顶枕沟两侧
D. 中央沟两侧
E. 侧副沟两侧

正确答案：B。距状沟两侧

解析：大脑皮质视觉区位于距状沟两侧（B对）。